下列哪项是病例对照研究
A. 根据既往死亡或发病情况，对将来疾病的发生作出估计
B. 根据所积累的有关某病与某因素的关系的假设，对不同地区和不同情况下进行的既往研究作分析
C. 为了解病例和对照中欲研究因素的相对频率，获得病例组和对照组的病史及其他信息
D. 在已戒烟的男性和尚在吸烟的对照中，研究癌症的相对危险度
E. 研究不同层次人群中某病的流行率

正确答案：C。为了解病例和对照中欲研究因素的相对频率，获得病例组和对照组的病史及其他信息

解析：本题考查病例对照研究的概念。病例对照研究是以当前已经确诊的患有某特定疾病的一组病人作为病例组，以不患有该病但具有可比性的一组个体作为对照组，通过询间、实验室检查或复查病史，搜集研究对象既往对各种可能的危险因素的暴露史（C对ABDE错），测量并采用统计学检验，比较病例组与对照组各因素暴露比例的差异是否具有统计学意义，然后评估各种偏倚对研究结果的影响，并借助病因推断技术，判断某个或某些暴露因素是否为疾病的危险因素，从而达到探索和检验病因假说的目的。